下列人群处于正氮平衡的是
A. 儿童
B. 成人
C. 老年人
D. 消耗性疾病患者
E. 处于饥饿状态的人群

正确答案：A。儿童